关于防风通圣丸特点和质量要求的说法，错误的是
A. 包衣可以防止丸中薄荷、荆芥中挥发性成分散失
B. 滑石既是处方中药物，粉碎为极细粉又可用作包衣
C. 大黄煎取药汁泛丸，既能使之成型又可发挥其药效作用
D. 应控制制剂的水分不得过9.0%
E. 应密封贮存防止受潮、发霉、变质等

正确答案：C。大黄煎取药汁泛丸，既能使之成型又可发挥其药效作用

解析：本题考查的是防风通圣丸的注解。防风通圣丸以芒硝水溶液泛丸，既能使之成型，又能起治疗作用（C错，为本题正确答案）。防风通圣丸：【注解】本品为采用泛制法制备的水丸。滑石粉在方中既是药物，又用作包衣材料（B对），节省了辅料，同时也可以防止薄荷、荆芥中的挥发性成分散失（A对）。方中芒硝主要成分为Na₂SO₄·10H₂O，极易溶于水。以芒硝水溶液泛丸，既能使之成型，又能起治疗作用。在滑石粉中加入10%的MgCO3，可增加洁白度，并增强其附着力。包衣前丸粒应充分干燥，包衣时撒粉用量要均匀，黏合剂浓度要适量，否则易造成花斑。防风通圣丸为水丸，除另有规定外，水丸中所含水分不得过9.0%（D对）。除另有规定外，丸剂应密封贮存，防止受潮、发霉、虫蛀、变质（E对）。